能引起肠源性青紫症的是
A. 组胺
B. 亚硝酸盐
C. 有机磷
D. 砷
E. 苯

正确答案：B。亚硝酸盐